某女，34岁。哺乳期患急性乳腺炎，症见乳房胀痛，皮色微红，皮肤发热，内有肿块，乳汁不畅；舌红苔薄黄，脉弦数。宜选用的中成药是
A. 牛黄化毒片
B. 乳康片
C. 乳疾灵颗粒
D. 乳增宁胶囊
E. 乳癖消胶囊

正确答案：A。牛黄化毒片

解析：本题考查的是乳痈的辨证论治。哺乳期患急性乳腺炎，症见乳房胀痛，皮色微红，皮肤发热，内有肿块，乳汁不畅；舌红苔薄黄，脉弦数。宜选用的中成药是牛黄化毒片（A对）。乳痈是发生在乳房部最常见的急性化脓性疾病，其临床特点是乳房结块，红肿热痛，溃后脓出稠厚，伴恶寒发热等全身症状。本病好发于产后1个月以内的哺乳妇女，尤以初产妇为多见。西医学的急性化脓性乳腺炎表现为上述症状者，可参考此内容辨证论治。（一）气滞热壅证：【症状】乳汁郁积结块，皮色不变或微红，肿胀疼痛；伴恶寒发热，周身酸楚，口渴，便秘。舌苔薄，脉数。【中成药应用】常用中成药有活血解毒丸、活血消炎丸。（二）热毒炽盛证：【症状】乳房肿痛加剧，皮肤焮红灼热，继之肿块变软，有应指感；或溃后脓出不畅，红肿热痛不消，有“传囊”现象；伴壮热不退，口渴喜饮，便秘溲赤。舌质红，苔黄腻，脉洪数。【中成药应用】常用中成药有牛黄化毒片、九一散。乳康片（B错）与乳疾灵颗粒（C错）为乳癖肝郁痰凝证的中成药应用。乳癖肝郁痰凝证：【症状】多见于青壮年妇女。乳房肿块，质韧不坚，胀痛或刺痛，症状常随喜怒消长；伴胸闷胁胀，善郁易怒，失眠多梦，心烦口苦。舌苔薄黄，脉弦滑。【中成药应用】常用中成药有乳核散结片、乳疾灵颗粒、乳康片。乳增宁胶囊（D错）为乳癖冲任失调证的中成药应用。乳癖冲任失调证：【症状】多见于中年妇女。乳房肿块月经前加重，经后缓解；伴腰膝酸软，神疲倦怠，月经失调，量少色淡，或闭经。舌质淡，苔白，脉沉细。【中成药应用】常用中成药有乳增宁胶囊。乳癖消胶囊（E错）：【功能】软坚散结，活血消痈，清热解毒。【主治】痰热互结所致的乳癖、乳痈，症见乳房结节、数目不等、大小形态不一、质地柔软，或产后乳房结块、红热疼痛；乳腺增生、乳腺炎早期见上述证候者。